上下颌突联合过多则形成
A. 唇裂
B. 小口畸形
C. 斜面裂
D. 侧鼻裂
E. 下颌裂

正确答案：B。小口畸形

解析：上下颌突未联合或部分联合，发生横面裂，若联合过多则形成小口畸形。掌握“面部的发育”知识点。